脾气虚衰、湿邪内阻，常见的面色特征是
A. 面黄红润
B. 面黄萎黄
C. 面黄如橘
D. 面黄虚胖
E. 面黄晦暗

正确答案：D。面黄虚胖

解析：本题考查的是望色的临床表现和意义。脾气虚衰、湿邪内阻，常见的面色特征是面黄虚胖（D对）。面色黄色的临床意义：黄色主虚证、湿证。黄为脾虚、湿蕴的征象。故脾失健运，而气血不充，或水湿不化者，面即常见黄色。面色淡黄，枯槁无泽，称为萎黄（B错），多属脾胃气虚、营血不能上荣之故。若面色黄而虚浮，称为黄胖，多是脾气虚衰、湿邪内阻所致。如面、目、身俱黄，称为黄疸，其中黄而鲜明如橘子色（C错）者，为阳黄，多属湿热；黄而晦暗（E错）如烟熏者，为阴黄，多属寒湿。面微黄红润（A错）而有光泽，一般为国人的正常面色。